无牙颌患者下颌处于正中关系位时上下颌牙槽嵴顶间的距离称为
A. 开口度
B. 息止（牙合）间隙
C. 垂直距离
D. 颌间距离
E. 覆（牙合）

正确答案：D。颌间距离

解析：本题考查颌间距离。无牙颌患者的牙齿全部缺失，牙周组织出现吸收，下颌处于正中关系是上下颌牙槽嵴顶之间的距离称为颌间距离（D对）。开口度（A错）是指患者大张口时，上下中切牙切缘之间的距离。息止（牙合）间隙（B错）是指下颌处于下颌姿势位时，上下颌之间呈楔形的间隙。垂直距离（C错）是自然牙列呈正中（牙合）时，鼻底至颏底的距离，也就是面部下1/3的距离。覆（牙合）（E错）是指牙尖交错（牙合）时，上颌牙盖过下颌牙唇颊面的垂直距离。